可作为片剂崩解剂的是
A. 硬脂酸镁
B. 羧甲基淀粉钠
C. 乙基纤维素
D. 羧甲基纤维素钠
E. 硫酸钙

正确答案：B。羧甲基淀粉钠

解析：本题考查片剂的常用辅料。崩解剂系指促使片剂在胃肠液中迅速破裂成细小颗粒的辅料。常用的崩解剂有：干淀粉、羧甲基淀粉钠（CMS-Na）（B对）、低取代羟丙基纤维素、交联羧甲基纤维素钠（CCMC-Na）、交联聚维酮（PVPP）和泡腾崩解剂（碳酸氢钠和枸橼酸组成的混合物，也可以用柠檬酸、富马酸与碳酸钠、碳酸钾、碳酸氢钾）等。硬脂酸镁（A错）为润滑剂。乙基纤维素（C错）和羧甲基纤维素钠（D错）为黏合剂。硫酸钙（E错）为稀释剂。